1ml水在营养琼脂培养中经37℃培养24小时后生长的细菌菌落总数
A. 细菌总数
B. 总大肠菌群
C. 粪大肠菌群
D. 粪链球菌群
E. 肠球菌总数

正确答案：A。细菌总数

解析：本题考查细菌总数。细菌总数（A对BCDE错）指1ml水在普通琼脂培养基中经37℃培养24小时后生长的细菌菌落数。它可以反映水体受生物性污染的程度，水体污染愈严重，水的细菌总数愈多。